吗啡最严重的不良反应是
A. 瞳孔极度缩小
B. 便秘
C. 成瘾
D. 恶心呕吐
E. 排尿困难

正确答案：C。成瘾

解析：本题考查吗啡的不良反应。吗啡最严重的不良反应是成瘾（C对）。成瘾是吗啡最严重的不良反应，连续多次应用易产生耐受性和成瘾性，对人体危害巨大，所以对于吗啡的临床用药非常严格，应按国家颁布的《麻醉药品管理条例》限制使用，一般连续用药不得超过1周。瞳孔极度缩小（A错）是吗啡的急性中毒反应。便秘（B错）、恶心呕吐（D错）、排尿困难（E错）是吗啡的常见不良反应。